正常牙髓中的一种重要的细胞，包括有CD4和CD8阳性细胞的是
A. 成纤维细胞
B. 成牙本质细胞
C. 树突状细胞
D. T淋巴细胞
E. 巨噬细胞和未分化的间充质细胞

正确答案：D。T淋巴细胞

解析：T淋巴细胞：是正常牙髓中的一种重要的细胞，包括有CD4和CD8阳性细胞。它们是牙髓中主要免疫反应细胞。掌握“牙髓”知识点。